男，35岁。发热、咳黄痰10天，水肿伴恶心、呕吐、呼吸困难1周，1天前突发抽搐昏迷。既往IgA肾病5年。查体：BP180/110mmHg，贫血貌，深大呼吸，双中下肺野闻及湿啰音，心率120次/分。双下肢水肿。Hb68g/L，Scr1325umol/L。患者意识障碍最可能的原因是
A. 高血压脑病
B. 低钙血症
C. 尿毒症脑病
D. 贫血
E. 脑血管病

正确答案：C。尿毒症脑病

解析：青年男性患者，既往IgA肾病5年。发热、咳黄痰10天（提示合并肺部感染，感染为慢性肾衰竭急性加重的常见诱因）。水肿（水、钠潴留引起）伴恶心、呕吐（伴发消化道症状，是慢性肾衰最早最突出的症状）、呼吸困难1周（考虑由肺部感染引起）。查体：BP180/110mmHg（正常为90～130/60～90mmHg，提示有高血压），贫血貌、Hb68g/L（正常为120～160g/L，提示有贫血），心率120次/分（正常为60～100次/分，提示心率增快）、深大呼吸、双中下肺野闻及湿罗音（肺部感染的表现）。Scrl325μmol/L（血肌酐正常为88.4～176.8μmol/L，提示血肌酐升高）。综合患者的病史、临床表现、实验室检查，考虑诊断为慢性肾衰竭。根据我国慢性肾衰竭的分期方法判断（Scr≥707μmol/L为尿毒症阶段），该患者已处于尿毒症阶段。患者意识障碍最可能的原因是尿毒症脑病（C对）。尿毒症脑病常表现为反应淡漠、谵妄、惊厥、幻觉、昏迷、精神异常等。高血压脑病（P257）（A错）一般以突发急剧的血压与颅内压升高的症状为主，其中以舒张压大于120mmHg为其重要特征；